应列为国家重点监测药物不良反应报告范围的药品是
A. 上市5年以内的药品
B. 上市4年以内的药品
C. 上市3年以内的药品
D. 上市2年以内的药品
E. 上市1年以内的药品

正确答案：A。上市5年以内的药品